病理性的持续睡眠状态，可被唤醒，并能正确回答问题称为
A. 嗜睡
B. 意识模糊
C. 昏睡
D. 昏迷
E. 谵妄

正确答案：A。嗜睡

解析：嗜睡（A对）是最轻的意识障碍，患者陷入持续的睡眠状态，可被唤醒，并能正确回答和做出各种反应，但当刺激去除后很快又再入睡。意识模糊（B错）是意识水平轻度下降，较嗜睡为深的一种意识障碍，表现为注意力减退，情感反应淡漠定向力障碍。昏睡（C错）是接近于人事不省的意识状态，患者处于熟睡状态，不易唤醒。昏迷（D错）是严重的意识障碍，表现为意识持续的中断或完全丧失。此外，还有一种以兴奋性增高为主的高级神经中枢急性活动失调状态，称为谵妄（E错）。